大便出血，同时伴有黏液，呈持续性，肛门坠胀，多见于
A. 息肉痔
B. 内痔
C. 混合痔
D. 肛裂
E. 锁肛痔

正确答案：E。锁肛痔

解析：锁肛痔的早期症状为便血、大便习惯改变，病情进一步发展可出现大便次数增多，有里急后重、排便不尽感，粪便中有血、脓、粘液，同时肛门内有不适或下坠感；病程后期则会出现大便变形，腹胀、腹痛、肠鸣等肠梗阻现象；后期还会出现转移征象（E对）。息肉痔是指发生于结直肠黏膜上的赘生物，是一种常见的结直肠良性肿瘤。其临床特点为肿物蒂小质嫩，其色鲜红，便后出血（A错）。内痔，其主要临床表现为便血、痔核脱出及肛门不适感（B错）。混合痔的临床表现具有内外痔的双重症状，内痔表现为便血、痔核脱出及肛门不适感，外痔主要表现为自觉肛门坠胀、疼痛，有异物感（C错）。肛裂，其临床特点为肛门周期性疼痛、出血、便秘（D错）。